25岁，男性。春季，主诉寒战，高热，剧烈头痛1天，呕吐3次，查体：神志清楚，体温39.8℃，颈强直（+），皮肤有瘀点，咽部充血，心肺腹无异常，克氏征阴性。血白细胞20×10⁹/L，中性粒85%。腰穿：脑脊液米汤样，细胞数3000×10⁶/L，中性粒80%，糖1.12mmol/L。最有效的治疗是
A. 青霉素G
B. 头孢霉素
C. 环丙沙星
D. 氯霉素
E. 庆大霉素

正确答案：A。青霉素G

解析：患者春季发病，寒战，高热，剧烈头痛、呕吐，体温39.8度，颈强直（+），皮肤有瘀点，咽部充血，血中白细胞中性粒细胞升高，脑脊液米汤样，细胞数和中性粒细胞皆升高，糖减少，应诊断为流行性脑脊髓膜炎。青霉素G（A对）为流脑首选药。头孢霉素（B错）为第一代头孢菌素，对金黄色葡萄球菌、溶血性链球菌、肺炎链球菌、大肠杆菌、奇异变形杆菌、肺炎克雷白杆菌、流感嗜血杆菌等有抗菌作用。环丙沙星（C错）庆大霉素（E错）多用于治疗革兰氏阴性菌引起的疾病。氯霉素（D错）有抑制骨髓造血的作用，故多用于青霉素过敏的患者。